合并糖尿病的高血压患者，血清肌酐正常，降压治疗宜首选的药物是
A. 噻嗪类利尿剂
B. α受体阻滞剂
C. 血管紧张素转换酶抑制剂
D. 二氢吡啶类钙通道阻滞剂
E. β受体阻滞剂

正确答案：C。血管紧张素转换酶抑制剂

解析：合并糖尿病的高血压患者降压治疗宜首选的药物是血管紧张素抑制剂（C对）。因为血管紧张素抑制剂（ACEI）可抑制交感-肾素-血管紧张素-醛固酮系统，扩张外周血管而降低血压；还可改善胰岛素抵抗、减少尿蛋白形成，因此特别适合于合并糖尿病的高血压患者。噻嗪类利尿剂（A错）可使血脂、血糖、血尿酸升高，β受体阻滞剂（P253）（E错）能增加胰岛素抵抗，还可能掩盖和延长低血糖反应，两者都不适合用于合并糖尿病的高血压患者。用于抗高血压治疗的α受体阻滞剂（B错）主要为α₁受体阻滞剂，如哌唑嗪、特拉唑嗪等，因其副作用较多，目前不主张单独使用。二氢吡啶类钙通道阻滞剂（P255）（D错）对血脂、血糖等无明显影响，可用于高血压合并糖尿病患者，但并非首选降压药物。